促进IgE产生的细胞因子
A. IL-1
B. IL-2
C. IL-3
D. IL-4
E. IL-5

正确答案：D。IL-4

解析：IL-4可诱导IgG和IgE的产生（D对）；TGF-β和IL-5诱导IgA的产生（E错）。IL-1（A错）主要功能是参与T细胞、NK细胞和巨噬细胞活化，诱导急性期反应蛋白和发热。IL-2（B错）主要功能是刺激T细胞的生长和分化，激活NK细胞和巨噬细胞，促进CTL功能。IL-3（C错）主要作用为促进骨髓中多能造血干细胞的定向分化与增殖，产生各种类型的血细胞。